子宫内膜不规则脱落
A. 经前诊刮子宫内膜分泌不足
B. 经期第5天子宫内膜为混合型
C. 经前诊刮子宫内膜呈增殖期
D. 经前诊刮子宫内膜为分泌期
E. 子宫内膜为蜕膜

正确答案：B。经期第5天子宫内膜为混合型

解析：子宫内膜不规则脱落在月经周期中，患者有排卵，黄体发育良好，但萎缩过程延长，导致子宫内膜不规则脱落。表现为月经间隔时间正常，但经期延长，长达9-10日，且出血量多。正常月经期第3-4日时，分泌期内膜已全部脱落，代之以再生的增生期内膜。但在子宫内膜不规则脱落时，于月经期第5-6日仍能见到呈分泌反应的内膜。掌握“功能失调性子宫出血”知识点。